体内半衰期最长的抗菌药物是
A. 头孢呋辛
B. 阿莫西林
C. 头孢唑林
D. 头孢他啶
E. 头孢曲松

正确答案：E。头孢曲松

解析：本题考查头孢曲松的半衰期。大多数头孢的半衰期都比较短，大部分是0.5～2小时，有的会达到3小时。头孢曲松（E对）是第三代头孢，是一种非常特殊的头孢菌素，半衰期极长，可达8小时。